以下哪种不是免疫细胞表面的功能分子
A. TCR
B. BCR
C. FcR
D. GVHR
E. CR

正确答案：D。GVHR